可能诱发呼喘，因此过敏体质者、有支气管哮喘病史者慎用的抗骨质疏松药物是
A. 雷洛昔芬
B. 骨化三醇
C. 阿仑膦酸钠
D. 鲑降钙素
E. 唑来膦酸

正确答案：D。鲑降钙素

解析：本题考查鲑降钙素。可能诱发呼喘，因此过敏体质者、有支气管哮喘病史者慎用的抗骨质疏松药物是鲑降钙素（D对）。雷洛昔芬（A错）不良反应常见外周水肿、潮热、出汗、下肢痛性痉挛；罕见头痛、皮疹、类流感样综合征、血压升高。骨化三醇（B错）可引起高钙血症。阿仑膦酸钠（C错）不良反应是可引起食管炎。注射用唑来膦酸（E错）可致“类流感样”反应，表现为高热、肌肉酸痛等症状。